下列哪一项不属于地图舌的临床表现
A. 丝状乳头片状剥脱
B. 菌状乳头清晰可见
C. 有明显烧灼感或刺激性痛
D. 剥脱区微凹陷
E. 剥脱区光滑红色

正确答案：C。有明显烧灼感或刺激性痛

解析：地图舌患者一般无明显的自觉症状，有时有烧灼感或刺激性痛。掌握“地图舌、沟纹舌及舌乳头炎”知识点。